下列有关伤寒肥达反应的描述，正确的是
A. 只要阳性就有明确诊断价值
B. 阴性结果即可除外伤寒
C. 可根据"O"抗体效价的不同区别伤寒或副伤寒
D. "H"抗体出现较早，消失快，更有利于诊断
E. 检测Vi抗体可用于慢性带菌者的调查

正确答案：E。检测Vi抗体可用于慢性带菌者的调查

解析：Vi抗原其抗原性较弱，随着伤寒杆菌从人体清除，Vi抗体滴度迅速下降以至消失，Vi抗体的检测有助于伤寒杆菌带菌者的筛查，因此，检测Vi抗体可用于慢性带菌者的调查（E对）；肥达反应在病程中效价增高4倍以上有助于诊断，而不是只要阳性就有明确诊断价值（A错）；少数免疫力低下的伤寒、副伤寒患者，肥达试验效价始终不高，甚至阴性，因此阴性结果可除外伤寒（B错）是错误的；伤寒和副伤寒甲、乙、丙杆菌有共同的O抗原，能刺激机体产生相同的“O”抗体，所以可根据“O”抗体效价的不同区别伤寒或副伤寒（C错）并不可靠；若仅有“O”抗体效价增高，而“H”抗体效价正常，可能是发病初期；仅有“H”抗体升高而“O”抗体正常可能是回忆反应，与既往接种过伤寒、副伤寒菌苗或层患伤寒有关，因此，单独出现H抗体增高，对伤寒辅助诊断价值不大，所以，“H”抗体出现较早，消失快，更有利于诊断（D错）是错误的。